保持菌体固有形态和维持菌体内外的渗透压的结构是
A. 细胞壁
B. 细胞膜
C. 细胞质
D. 细胞浆
E. 包膜

正确答案：A。细胞壁

解析：细胞壁为包绕在细胞膜外的膜状结构，其主要功能为保持菌体固有形态和维持菌体内外的渗透压。掌握“细菌的大小、形态和基本结构”知识点。